男，59岁，体检发现血糖升高。既往体健，查体：T36.5℃，P80次/分，R18次/分，BP120/80mmHg，BMI29kg/m²，腹型肥胖，75g葡萄糖耐量试验结果如下：糖化血红蛋白7.9%，ALT86U/L，AST34U/L，SCr101μmol/L。腹部超声提示中度脂肪肝。患者首选的降糖药物是
A. 阿卡波糖
B. 那格列奈
C. 胰岛素
D. 二甲双胍
E. 罗格列酮

正确答案：D。二甲双胍

解析：中年男性患者，体型肥胖（BMI＜18.5为偏瘦，18.5～23.9为正常体型，24.0～27.9为超重，≥28为肥胖）（2型糖尿病好发人群），糖化血红蛋白7.9%，考虑诊断为2型糖尿病。患者应在进行生活方式干预的同时给予口服药物治疗，二甲双胍主要通过抑制肝葡萄糖输出，改善外周组织对胰岛素的敏感性，增加对葡萄糖的摄取和利用而降低血糖，可减轻体重，改善血脂谱。主要适用于肥胖或超重的2型糖尿病患者，其不良反应较少，为2型糖尿病患者的一线降糖药物，故二甲双胍为首选（D对）。阿卡波糖（A错）和瑞格列奈（B错）主要用于降低餐后高血糖。胰岛素（C错）主要用于1型糖尿病以及各种严重的糖尿病急性或慢性并发症等。罗格列酮（E错）为胰岛素增敏剂，主要用于胰岛素抵抗的2型糖尿病。